患者腹胀，腹部时有条索状物聚起，按之胀痛更甚，便秘，纳呆，舌苔腻，脉弦滑。治疗应首选
A. 逍遥散
B. 六磨汤
C. 柴胡疏肝散合失笑散
D. 膈下逐瘀汤合六君子汤
E. 八珍汤合化积丸

正确答案：B。六磨汤

解析：逍遥散为聚证肝气郁结证的选方，功能疏肝解郁，健脾养血（A错）。题中患者以腹胀，腹部时有条索状物聚起为主症，故诊断为积聚，聚属无形，故多腹部胀痛，为饮食内伤，脾失健运，痰湿内生，痰食交阻所致，气聚不散，攻冲于外，故腹部时有条索状物聚起，有形之邪壅滞于腹，按之气愈不通，故按之胀痛更甚，腑气不通，故便秘，纳呆。舌苔腻，脉弦滑为痰食阻气之象，故辨为食滞痰阻证，治宜理气化痰，导滞散结，方选六磨汤（B对）。柴胡疏肝散合失笑散为积证气滞血阻证的选方，两方合用功能理气消积，活血散瘀（C错）。膈下逐瘀汤合六君子汤为积证瘀血内结证的选方，两方合用功能祛瘀软坚，扶正健脾（D错）。八珍汤合化积丸为积证正虚瘀结证的选方，两方合用功能补益气血，活血化瘀（E错）。